某男，65岁。哮喘10余年，气短乏力，痰多清稀，食纳减少，腹胀便溏，足面浮肿。舌淡苔白，脉细弱。根据八纲辨证，该证属于
A. 表证
B. 寒证
C. 热证
D. 虚证
E. 阳证

正确答案：D。虚证

解析：本题考查的是八纲辨证。哮喘10余年，气短乏力，痰多清稀，食纳减少，腹胀便溏，足面浮肿。舌淡苔白，脉细弱。根据八纲辨证，该证属于虚证（D对）。肺脾两虚证的临床表现及辨证要点：肺脾两虚证的临床表现，常见久咳不已，短气乏力，痰多清稀，食纳减少，腹胀便溏，甚则足面浮肿，舌淡苔白，脉细弱。一般以咳喘、纳少、腹胀便溏为主，伴见气虚症状为辨证要点。虚证的临床表现及辨证要点：虚证，指人体正气不足所表现的证候。其虽有阴、阳、气、血虚损的区分，但凡属虚证者，皆为人体正气不足所表现的证候。虚证的形成，有先天不足和后天失养两个方面，但以后天失于调养为主。如饮食失调，后天之本不固，七情劳倦，内伤脏腑气血，房事过度，耗散肾脏元真，或久病以及失治、误治损伤正气等，均可致成虚证。虚证有阴虚、阳虚、气虚、血虚等多种证候的不同，所以临床表现亦极不一致，很难概括全面。常见的有：面色苍白或萎黄，精神萎靡，身疲乏力，心悸气短，形寒肢冷或五心烦热，自汗盗汗，大便滑脱，小便失禁，舌上少苔无苔，脉虚无力等。以症状表现为不足、虚弱为辨证要点。表证（A错）的临床表现及辨证要点：表证，指的是病位浅在肌肤的一类证候。一般是指六淫之邪从皮毛、口鼻侵入人体而引起的外感病初起阶段。其临床表现以发热恶寒，或恶风，舌苔薄白，脉浮为主。常兼见头身疼痛、鼻塞、咳嗽等症状。以起病急、病程短、有发热恶寒的症状为辨证要点。寒症（B错）的临床表现及辨证要点：寒证，是指感受寒邪，或阳虚阴盛、机体的功能活动衰减所表现的证候。其临床表现常见恶寒喜暖，口淡不渴，面色苍白，肢冷踡卧，小便清长，大便溏稀，舌淡苔白而润滑，脉迟或紧等症状。以寒为主，功能减退为辨证要点。热证（C错）的临床表现及辨证要点：热证，多指由外感火热之邪，或因七情过激、郁而化火，或饮食不节、积蓄为热，或房事劳倦、劫夺阴精、阴虚阳亢，或阳盛阴虚，表现为机体的功能活动亢进的证候。其临床表现多见发热喜凉，口渴饮冷，面红目赤，烦躁不宁，小便短赤，大便燥结，舌红苔黄而干燥，脉数等症状。以热为主，功能活动亢进为辨证要点。阳证（E错）的临床表现及辨证要点：阳证的形成，多由于邪气盛而正气未衰，正邪斗争处于亢奋阶段，常见于里证的实热证。其在临床常表现为身热，恶热不恶寒，心烦口渴，躁动不安，气高而粗，口鼻气热，目睛了了不寐，目睛视物模糊或目赤多眵，面唇色红，爪甲色红，小便红赤，大便或秘或干，舌质红绛，脉滑数有力等症状。阳证以见热象为辨证要点